某男，患肺炎，经抗生素治疗后好转，现症见：干咳少痰，咳嗽声低，气短神疲，身热，手足心热，自汗，心胸烦闷，口渴欲饮，舌红，苔薄黄，脉细数。其治疗宜首选
A. 生脉散合四逆汤
B. 沙参麦冬汤
C. 竹叶石膏汤加减
D. 补肺汤
E. 清营汤

正确答案：C。竹叶石膏汤加减

解析：患者干咳少痰，咳嗽声低，气短神疲，身热，手足心热，自汗，心胸烦闷，口渴欲饮，诊断为肺炎，为正虚邪恋证，治疗首选竹叶石膏汤加减（C对）。阴竭阳脱证治疗用生脉散合四逆汤（A错）。肺肾气阴两虚证治疗用沙参麦冬汤加减（B错）。热闭心包证治疗用清营汤（E错）。肺脾气虚证治疗用补肺汤（D错）。